男，60岁。高血压病30余年，糖尿病10余年，发现双侧肾动脉狭窄2年。禁用的药物
A. 血管紧张素
B. β受体阻滞剂
C. 钙拮抗剂
D. 噻嗉类利尿剂
E. ɑ受体阻滞剂

正确答案：A。血管紧张素

解析：老年男性患者，高血压病30余年，糖尿病10余年，发现双侧肾动脉狭窄2年，应禁用的药物血管紧张素（A对），因其为升压药，药理作用是使血管收缩，增大外周阻力，从而加重患者高血压及肾缺血。β受体阻滞剂（B错）、钙拮抗剂（C错）、噻嗪类利尿剂（D错）及α受体阻滞剂（E错）均为降压药，可降低血压，可用于该患者。